流行病学研究中最为重要的研究方法是
A. 观察法
B. 实验法
C. 理论法
D. 方法学研究
E. 以上都不是

正确答案：A。观察法

解析：本题考查流行病学的研究方法。流行病学以观察法（A对BCDE错）、实验法和数理法为基本，其中尤以观察法的用途最广泛，最为重要。